在某地进行的吸烟与肺癌关系的研究显示，该地人群肺癌年死亡率为0.56‰，吸烟与不吸烟者的肺癌年死亡率分别为0.96‰和0.07‰。上述研究的人群归因危险度（PAR）为
A. 0.927
B. 0.875
C. 0.49‰
D. 0.89‰
E. 0.40‰

正确答案：C。0.49‰